妇女绝经后骨质疏松患者在维生素D加钙制剂治疗且无HRT禁忌症的基础上，可联合选用
A. 尼尔雌醇
B. 阿仑膦酸钠
C. 氢氯噻嗪
D. 尿促红素
E. 苯妥英钠

正确答案：A。尼尔雌醇

解析：本题考查骨质疏松症的药物治疗。在基础治疗即钙制剂+VD的基础上，联合雌激素用药，须注意适应证与禁忌症，当没有激素替代治疗（HRT）禁忌症的基础上才可以选用雌激素（尼尔雌醇（A对））或选择性雌激素受体调节剂治疗。阿仑膦酸钠（B错）与维生素D和钙制剂联合用于治疗老年性骨质疏松。氢氯噻嗪（C错）为利尿药、抗高血压药。尿促性素（D错）治疗垂体功能低下的无排卵患者可使软泡发育。苯妥英钠（E错）为抗癫痫药、抗心律失常药。